接受左侧胸壁上部肋间后静脉血的是
A. 锁骨下静脉
B. 胸廓内静脉
C. 奇静脉
D. 半奇静脉
E. 副半奇静脉

正确答案：E。副半奇静脉

解析：副半奇静脉（E对）接受左侧胸壁上部的肋间后静脉血液。